六淫之邪不包括
A. 风
B. 寒
C. 湿
D. 燥
E. 瘀

正确答案：E。瘀

解析：本题考查的是六淫的含义。六淫之邪不包括瘀（E错，为本题正确答案）。在中医病因学中六淫是最主要的发病因素之一。六淫即风（A对）、寒（B对）、暑、湿（C对）、燥（D对）、火六种外感病邪的统称。